精气概念源自于
A. 阴阳说
B. 水地说
C. 五行说
D. 元气说
E. 云气说

正确答案：B。水地说

解析：精气概念源自于：水地说（B对）；气的概念源于：云气说；构成宇宙的本源：精气；天地万物相互联系的中介是：精气；构成人体的本原物质是：精气。